相当于121℃热压灭菌时杀死容器中微生物所需时间的参数是
A. D值
B. Z值
C. Z₀值
D. F值
E. F₀值

正确答案：E。F₀值

解析：本题考查灭菌参数。F₀值（E对）是指在一定的灭菌温度（T）、Z值为10℃所产生的灭菌效果与121℃、Z值为10℃所产生的灭菌效果相同时所相当的时间（分钟）。D值（A错）是指在一定温度下杀灭90%的微生物（或残存率为10%）所需的灭菌时间。Z值（B错）是指降低1个lgD值所需升高的温度，即灭菌时间减少到原来的1/10所需升高的温度或在相同的灭菌时间内杀灭99%的微生物所需提高的温度。F值（D错）是指在一定的灭菌温度（T）下给定的Z值所产生的灭菌效果与在参比温度（T₀）下给定的Z值所产生的灭菌效果相同时所相当的时间。